关于小儿维生素D缺乏性佝偻病的预防措施，不正确的是
A. 适当多晒太阳
B. 孕母补充维生素D及钙剂
C. 早产儿2个月时开始补充维生素D
D. 提倡母乳喂养
E. 及时添加辅食

正确答案：C。早产儿2个月时开始补充维生素D

解析：早产儿应于生后1周开始补充维生素D（C错，为本题正确答案）。紫外线的照射有利于维生素D的合成，因此孕妇和婴儿适当多晒太阳（A对），可以预防维生素D缺乏性佝偻病。孕母补充维生素D及钙剂（B对），有益于胎儿贮存充足的维生素D，以满足生后一段时间生长发育的需要。另外母乳中所含钙磷的比例，最适于吸收，所以母乳喂养（D对）可以预防维生素D缺乏性佝偻病。处于生长高峰期的胎儿，及时添加辅食（E对）可以预防维生素D缺乏性佝偻病。